心脏内传导速度最快的部位是
A. 窦房结
B. 心房肌
C. 心室肌
D. 房室交界
E. 浦肯野纤维

正确答案：E。浦肯野纤维

解析：兴奋起源于窦房结（A错），产生的兴奋能直接传给心房肌细胞，心房（B错）内兴奋传导速度约为0.4m/s，兴奋在房室交界（D错）的传导非常慢，其传导速度仅约为0.02m/s，兴奋在心室肌（C错）的传导速度约为1m/s，浦肯野纤维（E对）十分粗大（70μm），且含肌原纤维很少，而缝隙连接数量又很多，故其兴奋传导速度是心内传导系统中最快的，可达4m/s左右。